具有抗乙肝病毒作用的核苷类药物是
A. 阿昔洛韦
B. 拉米夫定
C. 依法韦仑
D. 奥司他韦
E. 沙奎那韦

正确答案：B。拉米夫定

解析：本题考查核苷类抗病毒药。拉米夫定（B对）为抗乙型肝炎病毒药。阿昔洛韦（A错）为抗疱疹病毒药。依法韦仑（C错）为抗艾滋病毒的特效药物。奥司他韦（D错）为抗流感病毒药。沙奎那韦（E错）是第一个上市的治疗艾滋病的蛋白酶抑制剂。